根据《药品说明书和标签管理规定》，应当列出全部辅料名称的是
A. 注射剂说明书
B. 原料药标签
C. 药品内标签
D. 药品外标签
E. 药品小包装标签

正确答案：A。注射剂说明书

解析：本题考查药品说明书和标签管理。药品说明书应当列出全部活性成分或者组方中的全部中药药味。注射剂（A对）和非处方药还应当列出所用的全部辅料名称。